男，35岁。半小时前被自行车撞伤左胸，伤后疼痛，活动后加重，呼吸困难逐渐加重，查体：脉搏110次/分，气管向右移位，皮下气肿（+），其诊断可能性最大为
A. 闭合性气胸
B. 张力性气胸
C. 肋骨骨折合并单纯性气胸
D. 肋骨骨折
E. 肋骨骨折并张力性气胸

正确答案：E。肋骨骨折并张力性气胸

解析：青年男性患者，被自行车撞伤左胸，伤后疼痛，活动后加重（提示可能有肋骨骨折），呼吸困难逐渐加重，气管向右移位，皮下气肿（+）（提示可能有张力性气胸），结合患者病史、症状和体征，其诊断可能性最大为肋骨骨折并张力性气胸（E对BD错）。单纯性气胸（C错）即闭合性气胸（A错）患者症状较轻，一般无皮下气肿表现。